诊断肾细胞癌最可靠的影像学方法是
A. CT平扫
B. B超
C. 尿路平片+静脉尿路造影
D. 肾动脉造影
E. CT增强扫描

正确答案：E。CT增强扫描

解析：肾细胞癌在CT表现为肾实质内不均质肿块，平扫CT值可略低于或与肾实质相似，当平扫CT值与肾实质相等时，难以作出诊断；增强扫描后，正常肾实质明显增强，而肿瘤组织增强不明显，因此CT增强扫描（E对）对诊断肾细胞癌要比CT平扫（A错）更可靠。B超（B错）对肾癌的敏感性高，一般作为肾癌初步诊断的首选检查方法。尿路平片+静脉尿路造影（C错）是尿路结石最常用的检查手段。肾动脉造影（D错）主要用于超声、CT不能确诊的肾癌。